辐射逆温是由
A. 外来射线产生
B. 地表物体对辐射热的吸收量小于散出量产生的
C. 大气污染物阻挡太阳辐射产生
D. 地表物体的辐射产生
E. 反气旋产生

正确答案：B。地表物体对辐射热的吸收量小于散出量产生的

解析：本题考查辐射逆温。辐射逆温是由地表物体对辐射热的吸收量小于散出量产生的（B对ACDE错）。